闭经的治疗原则是
A. 补而通之，泻而通之
B. 理气活血，祛瘀通经
C. 益气养血，以益冲任
D. 补益肝肾，以填精血
E. 补中有通，补而不腻

正确答案：A。补而通之，泻而通之

解析：闭经，究其原因归纳起来不外虚实两端。虚者，多因肾气不足，冲任亏虚；或肝肾亏损，精血不足，或脾胃虚弱，气血乏源；或阴虚血燥精亏血少，导致冲任血海空虚，源断其流，无血可下而致闭经；实者，多为气血阻滞，或痰湿流注下焦，使血流不畅，冲任阻滞，血海阻隔，经血不得下行而成闭经。固治疗闭经的治则当为补而通之，泻而通之（A对）。